男性，56岁。食欲减退半年，巩膜轻度黄染，肝肋下及边。血红蛋白80g/L，红细胞3.1✕10¹²/L，网织红细胞2%。骨髓象示幼红细胞增生活跃，中、晚幼红细胞为主，幼红细胞体积小，胞质少、边缘不整，粒细胞系及巨核细胞系正常。上题处理，首先是
A. 输血
B. 铁剂治疗
C. 胃肠道检查
D. 治疗胃病
E. 肝功能检查

正确答案：C。胃肠道检查